不能防止药物氧化的方法是
A. 降低温度
B. 避免光线
C. 通入二氧化氮气体
D. 加抗氧剂
E. 加金属离子络合剂

正确答案：C。通入二氧化氮气体

解析：本题考查防止药物氧化的方法。不能防止药物氧化的方法是通入二氧化氮气体（C错，为本题正确答案）。防止药物氧化的方法：（1）降低温度（A对）：在制备和贮存过程中，应适当降低温度，以减少药物的氧化。（2）避光（B对）：在制备的全过程中，对光敏感的药物制剂应严格避免日光的照射，成品用棕色玻璃容器包装，避光贮藏。（3）驱逐氧气：可采取加热煮沸法驱逐溶液中的氧气或通入惰性气体（氮气、二氧化碳等）驱逐容器中的空气。（4）添加抗氧剂（D对）：药物的氧化降解通常表现为自动氧化降解，因此在驱逐氧气的同时，还应加入抗氧剂。（5）控制微量金属离子：制备过程应尽可能减少金属离子的带入，必要时在制剂成品中可加入金属离子络合剂（E对）。（6）调节pH：适宜的溶液pH，可延缓药物的氧化。因此对于容易氧化变质的药物，需调节药液的pH在最稳定的范围内。